婴儿目光能跟随移动的物体180°的年龄为
A. 满月
B. 1～2个月
C. 2～3个月
D. 3～4个月
E. 4～5个月

正确答案：D。3～4个月

解析：本题考查视觉发育规律的相关内容。婴儿期视觉发育迅速，3～4个月（D对ABCE错）婴儿目光能跟随移动的物体180°，6个月能跟随落地的物体。